研究并评价疾病防治和健康促进中的预防干预措施及其效果
A. 描述流行病学
B. 理论流行病学
C. 实验流行病学
D. 分析流行病学
E. 病例对照研究

正确答案：C。实验流行病学

解析：实验流行病学：主要是研究并评价疾病防治和健康促进中的预防干预措施及其效果。掌握“流行病学概论”知识点。